年轻恒牙的X线牙片显示未发育完成的根尖开口区有界限清晰透影，周围有完整骨硬板围绕，临床无异常症状。应提示为
A. 慢性根尖周肉芽肿
B. 慢性根尖周脓肿
C. 慢性根尖周囊肿
D. 慢性牙髓炎
E. 牙乳头

正确答案：C。慢性根尖周囊肿

解析：本题考查慢性根尖周炎的X线检查。年轻恒牙的X线牙片显示未发育完成的根尖开口区有界限清晰透影，周围有完整骨硬板围绕，临床无异常症状。应提示为慢性根尖周囊肿（C对）。临床无异常症状，X线牙片显示根尖开口区有界限清晰透影，周围有完整骨硬板围绕，提示为慢性根尖周囊肿，根尖周囊肿有完整的囊壁，故X线片显示透影界限清晰。慢性根尖周肉芽肿（A错）的X线片显示根尖无完整硬骨板围绕。慢性根尖周脓肿（B错），根尖部的脓液有时可穿透骨壁和软组织，X线片显示边界不清。慢性牙髓炎（D错）根尖无明显变化。牙乳头（E错）是牙胚的一部分，起源于外胚间叶，形成牙髓和牙本质，是牙发育中的一种组织，而不是一种疾病。